皮样囊肿穿刺可抽出
A. 血液
B. 蛋清样黏液
C. 乳白色豆渣样分泌物
D. 可含皮脂样物质或镜下可见胆固醇结晶
E. 黄绿色脓性物质

正确答案：C。乳白色豆渣样分泌物

解析：穿刺物：脉管畸形——血液；皮脂腺囊肿——白色乳凝状物；皮样囊肿——乳白色豆渣样分泌物（毛发）；表皮样囊肿——同上（无毛发）；甲状舌管囊肿——透明、浑浊黄色稀薄、黏稠液体；鳃裂囊肿——棕黄色清亮液体；根尖周囊肿、残余囊肿、含牙囊肿——草黄色囊液，含胆固醇晶体；牙源性角化囊肿——黄白色角蛋白（皮脂样）物质，含胆固醇晶体；成釉细胞瘤——褐色液体；神经鞘瘤——褐色液体，不凝结。